四环素的不良反应包括
A. 局部刺激
B. 二重感染
C. 影响牙、骨的生长
D. 肝脏毒性
E. 再生障碍性贫血

正确答案：A、B、C、D。局部刺激；二重感染；影响牙、骨的生长；肝脏毒性

解析：本题考查四环素的不良反应。四环素可引起局部刺激（A对）。应用四环素后，敏感菌受抑制，容易引起继发二重感染（B对）。四环素能与新形成的骨、牙中所沉积的钙相结合，影响牙、骨的生长（C对）。长期大量应用四环素可引起肝细胞脂肪变性，甚至坏死（D对）。未见四环素引起再生障碍性贫血（E错）报道。